前牙缺失多采用模型向后倾斜，义齿就位方向应
A. 垂直就位
B. 水平就位
C. 从前向后
D. 从后向前
E. 以上说法均正确

正确答案：C。从前向后

解析：本题考查局部义齿类型，肯氏分类及模型观测。前牙缺失多采用模型向后倾斜，义齿从前向后（C对）斜向就位，既可消除牙槽嵴唇侧组织倒凹，缩小人工前牙与远中邻牙间的间隙以利美观，又可以将固位倒凹集中于后方基牙的远中，有利于固位卡环的放置。